含两个手性碳全合成的他汀类药物有
A. 洛伐他汀
B. 阿伐他汀
C. 辛伐他汀
D. 氟伐他汀
E. 瑞舒伐他汀

正确答案：B、D、E。阿伐他汀；氟伐他汀；瑞舒伐他汀

解析：本题考查他汀类药物。含两个手性碳全合成的他汀类药物有阿伐他汀（B对）、氟伐他汀（D对）、瑞舒伐他汀（E对）。洛伐他汀（A错）有8个手性中心，辛伐他汀（C错）有7个手性中心。阿伐他汀、氟伐他汀、瑞舒伐他汀都是含两个手性中心。